具有“蚯蚓头”性状特征的药材是
A. 商陆
B. 防风
C. 川木香
D. 松贝
E. 天南星

正确答案：B。防风

解析：本题考查的是防风药材的性状鉴别。具有“蚯蚓头”性状特征的药材是防风（B对）。防风：【性状鉴别】药材呈长圆锥形或长圆柱形，下部渐细，有的略弯曲。根头部有明显密集的环纹，习称“蚯蚓头”，环纹上有的有棕褐色毛状残存叶基。表面灰棕色或棕褐色，粗糙，有纵皱纹、多数横长皮孔及点状突起的细根痕。体轻、质松，易折断，断面不平坦，皮部棕黄色至棕色，有裂隙，散生黄棕色油点，木质部浅黄色。气特异，味微甘。商陆（A错）：【性状鉴别】药材为横切或纵切的不规则块片，厚薄不等。外皮灰黄色或灰棕色。横切片弯曲不平，边缘皱缩；切面浅黄棕色或黄白色，异型维管束隆起，其木部明显，形成数个突起的同心性环轮，习称“罗盘纹”。纵切片弯曲或卷曲，异型维管束木部呈平行条状突起。质硬。气微，味稍甜，久嚼麻舌。川木香（C错）：【性状鉴别】药材呈圆柱形或有纵槽的半圆柱形，稍弯曲。表面黄褐色或棕褐色，具纵皱纹，外皮脱落处可见丝瓜络状细筋脉；根头偶有黑色发黏的胶状物，习称“油头”。体较轻，质硬脆，易折断，断面黄白色或黄色，有深黄色稀疏油点及裂隙，木部宽广，有放射状纹理；有的中心呈枯朽状。气微香，味苦，嚼之粘牙。松贝（D错）：【性状鉴别】呈类圆锥形或近球形。表面类白色。外层鳞叶2瓣，大小悬殊，大瓣紧抱小瓣，未抱部分呈新月形，习称“怀中抱月”；顶部闭合，内有类圆柱形、顶端稍尖的心芽有和小鳞叶1～2枚；先端钝圆或稍尖，底部平，微凹入，中心有1灰褐色的鳞茎盘，偶有残存的须根。质硬而脆，断面白色，富粉性。气微，味微苦。天南星（E错）：【性状鉴别】药材呈扁球形。表面类白色或淡棕色，较光滑，顶端有凹陷的茎痕，周围有麻点状根痕，有的块茎周边具小扁球状侧芽。质坚硬，不易破碎，断面不平坦，色白，粉性。气微辛，味麻辣。